硫脲类严重的不良反应是
A. 过敏反应
B. 粒细胞缺乏症
C. 血管神经性水肿
D. 甲状腺功能低下
E. 新生儿甲状腺肿

正确答案：B。粒细胞缺乏症

解析：本题考查硫脲类药物的不良反应。硫脲类严重的不良反应是粒细胞缺乏症（B对）。硫脲类药物严重的不良反应是粒细胞缺乏症，故需在用药期间定期检测血常规。过敏反应（A错）是硫脲类药物的常见不良反应。血管神经性水肿（C错）、甲状腺功能低下（D错）、新生儿甲状腺肿（E错）不是硫脲类药物的不良反应。